结核分枝杆菌的生物特性中，对临床诊断最有意义的是
A. 菌体结构复杂
B. 多形性
C. 生长缓慢
D. 抵抗力强
E. 抗酸性

正确答案：E。抗酸性

解析：结核分枝杆菌属于分枝杆菌，由于细胞壁结构中大量脂质的存在，一般染料很难渗透入细胞壁和细胞内，因此，结核分枝杆菌虽然是革兰氏阳性菌，但无法用革兰染色法进行鉴别。由于结核分枝杆菌的抗酸性（E对），一般使用齐-尼抗酸染色，结核分枝杆菌染成红色，而其他非抗酸染色性菌及细胞等呈蓝色，这是分枝杆菌和其他细菌的重要区别，对临床诊断最有意义。菌体结构复杂（A错）、多形性（B错）、生长缓慢（C错）、抵抗力强（D错）均是结核分枝杆菌的其他生物学特性，但不是独有特征，通常不作为对临床诊断有意义的参考。